如全冠试戴时出现翘动，可能的原因，除了
A. 全冠组织面有金属瘤
B. 邻接过紧
C. 预备体轴壁聚合度大
D. 未完全就位
E. 石膏代型磨损

正确答案：C。预备体轴壁聚合度大

解析：本题考查全冠试戴时出现翘动的原因。预备体轴壁聚合度大（C错，为本题的正确答案）会导致全冠固位力差，容易脱落，并不会出现翘动。全冠组织面有金属瘤（A对）、邻接过紧（B对）、未完全就位（D对）、石膏代型磨损（E对）都会形成支点，出现翘动。